某女，66岁。形体肥胖，既患痰湿壅肺之咳嗽气喘，又见脾胃气滞之脘腹胀满、嗳气、恶心呕吐。宜选用的药是
A. 陈皮
B. 川楝子
C. 香附
D. 甘松
E. 乌药

正确答案：A。陈皮

解析：本题考查的是陈皮的主治病证。宜选用的药是陈皮（A对）。陈皮【主治病证】（1）脾胃气滞之脘腹胀满或疼痛、嗳气、恶心呕吐。（2）湿浊中阻之胸闷腹胀、纳呆便溏。（3）痰湿壅肺之咳嗽气喘。川楝子（B错）【主治病证】（1）肝气郁滞或肝胃不和之胸胁、脘腹胀痛，疝气痛。（2）虫积腹痛。（3）头癣。香附（C错）【主治病证】（1）肝气郁滞之胸胁、脘腹胀痛，疝气痛。（2）肝郁之月经不调、痛经、乳房胀痛。（3）脾胃气滞，脘腹胀痛。甘松（D错）【主治病证】（1）思虑伤脾或寒郁气滞引起的胸闷、脘腹胀痛、不思饮食。（2）湿脚气。乌药（E错）【主治病证】（1）寒凝气滞之胸闷胁痛、脘腹胀痛、疝气疼痛及痛经。（2）肾阳不足、膀胱虚寒之小便频数、遗尿。